分泌抗体
A. NK细胞
B. B细胞
C. 肥大细胞
D. 细胞毒性T淋巴细胞
E. 浆细胞

正确答案：E。浆细胞

解析：浆细胞（E对）又称抗体形成细胞，是B细胞分化的终末细胞，能合成和分泌特异性抗体。NK细胞（A错）来源于骨髓淋巴样干细胞，无需抗原预先致敏，可直接杀伤某些肿瘤细胞和病毒感染细胞，没有产生抗体的功能。B细胞（B错）由淋巴样干细胞发育分化而来，经历了祖B细胞、前B细胞、未成熟B细胞和成熟B细胞几个阶段，最后只有分化成为浆细胞，才可以分泌抗体。肥大细胞（C错）仅存在于组织中，参与Ⅰ型超敏反应，通过脱颗粒可释放和合成一系列炎性介质（组胺、白三烯、前列腺素D2等）和促炎细胞因子（IL-1、IL-4、IL-8和TNF等）引发炎症反应，从而在机体抗感染、抗肿瘤和免疫调节中发挥重要作用，不产生抗体。细胞毒性T淋巴细胞（D错）为一种特异T细胞，专门分泌各种细胞因子参与免疫作用，对某些病毒、肿瘤细胞等抗原物质具有杀伤作用，与自然杀伤细胞构成机体抗病毒、抗肿瘤免疫的重要防线，没有分泌抗体的功能。